因感染导致恒磨牙的先天畸形，呈圆顶形，牙尖缩窄，咬合面直径小于牙颈部直径，咬合面及牙冠近咬合面1/3表面有许多颗粒状细小的釉质球团，为以下哪一项
A. 哈钦森切牙
B. 氟牙症
C. 牛牙症
D. 特纳牙
E. 桑葚状磨牙

正确答案：E。桑葚状磨牙

解析：由于梅毒螺旋体引起的第一恒磨牙的病变称桑葚牙，病变牙呈圆顶形，牙尖缩窄，咬合面直径小于牙颈部直径，咬合面及牙冠近咬合面1/3表面有许多颗粒状细小的釉质球团，呈桑葚状。掌握“氟牙症、先天性梅毒牙与牙本质形成缺陷”知识点。